患者女性，31岁，妊娠5个月。发现尿糖（+），口服葡萄糖耐量试验结果：空腹血糖10.6mmol/L，既往无糖尿病史。最可能的诊断是
A. 糖尿病合并妊娠
B. 妊娠期糖尿病
C. 糖耐量异常
D. 肾性糖尿
E. 继发性糖尿病

正确答案：B。妊娠期糖尿病